根尖诱导成形术后根尖孔封闭的时间是
A. 3～6个月
B. 3个月～2年
C. 6个月～1年
D. 6个月～2年
E. 1～2年

正确答案：D。6个月～2年

解析：本题考查根尖诱导成形术。根尖诱导成形术后根尖孔封闭的时间是6个月～2年左右（D对）。根尖诱导成形术治疗全过程分为两个阶段，第一阶段消除感染和根尖周病变，诱导牙根继续发育；第二阶段进行根管永久充填，使根尖孔封闭。两个阶段之间的间隔时间和牙根继续发育所需时间不等，为6个月至2年左右，其时间的长短与牙根原来的长度、根尖孔形态、根尖周炎症的程度以及患者的机体状况等有关。